股四头肌收缩可产生的运动是
A. 伸髋
B. 屈髋
C. 屈髋、伸膝
D. 伸髋、屈膝
E. 伸髋、伸膝

正确答案：C。屈髋、伸膝

解析：股四头肌收缩可产生的运动是屈髋、伸膝（C对）。